看不懂文字的意义，损伤部位在
A. 角回
B. 颞上回后部
C. 额中回后部
D. 韦尼克区
E. 左颞极

正确答案：A。角回